一患者因车祸伤及颅面部，有一过性昏迷病史，急诊检查发现颧部凹陷，眶周瘀血，咬合正常，张口受限。根据临床检查，对面骨骨折的诊断可能是
A. Le FortⅠ型骨折
B. Le FortⅡ型骨折
C. Le FortⅢ型骨折
D. 上颌骨纵形骨折
E. 颧骨颧弓骨折

正确答案：E。颧骨颧弓骨折

解析：本题考查颧骨及颧弓骨折的临床表现。一患者因车祸伤及颅面部，有一过性昏迷病史，急诊检查发现颧部凹陷，眶周瘀血，咬合正常，张口受限。根据临床检查，对面骨骨折的诊断可能是颧骨颧弓骨折（E对）。颧骨颧弓骨折可表现为颧面部塌陷畸形、张口受限、复视、神经症状和眶周瘀斑。上颌骨骨折根据骨折线的位置可分为Le FortⅠ、Ⅱ、Ⅲ型骨折（ABC错）及不对称型骨折、上颌骨纵形骨折（D错），临床表现有骨折线、骨折段移位，咬合关系错乱、眶及眶周变化、颅脑损伤，无颧面部塌陷。